材料二，A制药公司是一家现代化企业，许多产品在市场上口碑很好，B制药公司为获取更大利润，将自己产品的包装盒装潢设计的与A制药公司同类药品非常相似，并在印制药品说明书和标签假冒了A制药公司的注册商标，同时做了宣传和广告。关于上述信息中所指的药品注册商标的说法，正确的是
A. 药品说明书和标签中可以印制注册商标，但禁止使用未经注册的商标
B. 药品不能申请注册商标
C. 药品说明书中的药品注册商标必须印制在通用名称同行的边角上
D. 注册商标的单字面积不得大于通用名称所用字体的二分之一

正确答案：A。药品说明书和标签中可以印制注册商标，但禁止使用未经注册的商标

解析：本题考查药品标签的标识内容。材料二，A制药公司是一家现代化企业，许多产品在市场上口碑很好，B制药公司为获取更大利润，将自己产品的包装盒装潢设计的与A制药公司同类药品非常相似，并在印制药品说明书和标签假冒了A制药公司的注册商标，同时做了宣传和广告。关于上述信息中所指的药品注册商标的说法，正确的是药品说明书和标签中可以印制注册商标，但禁止使用未经注册的商标（A对）。注册商标：药品说明书和标签中禁止使用未经注册的商标以及其他未经国家药品监督管理部门批准的药品名称。药品标签使用注册商标的，应当印刷在药品标签的边角（C错），含文字的注册商标，其字体以单字面积计不得大于通用名称所用字体的四分之一（D错）。